男性，30岁，低热，乏力，咳嗽，痰中偶带血丝1年，胸片显示，双肺片状阴影，轮廓模糊，进一步的检查是
A. 结核菌素试验
B. 痰细胞学检查
C. 支气管镜检查
D. 痰培养加药敏试验
E. 经胸壁穿刺活组织检查

正确答案：A。结核菌素试验

解析：青年男性患者，低热，乏力，咳嗽，痰中偶带血丝（肺结核的典型症状）1年，胸片显示，双肺片状阴影，轮廓模糊（浸润性肺结核的典型X线征象），根据该患者的症状、体征及实验室检查，考虑最可能的诊断为肺结核，所以进一步的检查是结核菌素试验（A对），该检查敏感性、特异性高，培养后还可行药敏测试。痰细胞学检查（B错）对肺结核的诊断意义不大，一般是做痰涂片或痰培养。纤维支气管镜检查（C错）常应用于支气管结核和淋巴结支气管瘘的诊断。痰培养加药敏试验（D错）主要是初治失败、复发以及其他复治的病人，且耗时长。经胸壁穿刺活组织检查（E错）在肺结核的诊断中很少应用。